异位妊娠体征不包括
A. 阴道后穹隆饱满
B. 直肠子宫陷凹有触痛结节
C. 宫颈举痛
D. 子宫漂浮感
E. 子宫一侧有触痛包块

正确答案：B。直肠子宫陷凹有触痛结节

解析：异位妊娠盆腔检查：输卵管妊娠流产或破裂者时，可出现阴道后穹隆饱满（A对），有触痛；将宫颈轻轻上抬或向左右摆动时引起宫颈举痛（C对）；内出血多时，子宫有漂浮感（D对）；可在子宫一侧或其后方发现触痛明显的肿块（E对）。直肠子宫陷凹有触痛结节（P271）（B错，为本题正确答案）为子宫内膜异位症的体征。